一般认为在口服剂型中，药物吸收的快慢顺序大致是
A. 散剂＞水溶液＞混悬液＞胶囊剂＞片剂＞包衣片剂
B. 包衣片剂＞片剂＞胶囊剂＞散剂＞混悬液＞水溶液
C. 水溶液＞混悬液＞散剂＞胶囊剂＞片剂＞包衣片剂
D. 片剂＞胶囊剂＞散剂＞水溶液＞混悬液＞包衣片剂
E. 水溶液＞混悬液＞散剂＞片剂＞胶囊剂＞包衣片剂

正确答案：C。水溶液＞混悬液＞散剂＞胶囊剂＞片剂＞包衣片剂

解析：本题考查影响药物吸收的因素。口服剂型药物在胃肠道吸收顺序为溶液剂＞混悬剂＞胶囊剂＞片剂＞包衣片（C对）；口服药物要在胃肠道吸收，需要先从制剂中释放。水溶液不存在药物释放问题；混悬剂分散度大，释放药物迅速；胶囊剂外壳崩解后相当于散剂；包衣片相对于片剂要先溶解衣层，故吸收速度慢于片剂。